肾病综合征的中医证型，不包括的是
A. 脾虚湿困
B. 瘀血阻滞
C. 湿热内侵
D. 水湿浸渍
E. 肾阳衰微

正确答案：B。瘀血阻滞

解析：肾病综合征大多有水肿的临床表现，故临证多以水肿而论，是由于感受风寒或风热之邪、疮毒内侵、久居湿地及冒雨涉水、烦劳过度等因素导致肺失通调，脾失转输，肾失开阖，终致膀胱气化无权，三焦水道失畅，水液停聚而成本病。其中医证型有：1.风水相搏证；2.湿毒浸淫证；3.水湿浸渍证；4.湿热内侵证；5.脾虚湿困证；6.肾阳衰微证。故瘀血阻滞证不属于肾病综合征的中医证型（B错，为本题正确答案）。